前列腺癌筛查最常用的方法是
A. 盆腔CT
B. 盆腔MRI
C. 前列腺特异性抗原检测
D. 前列腺穿刺
E. 直肠指检

正确答案：C。前列腺特异性抗原检测

解析：首选：直肠指检 筛查：PSA 确诊：活检。筛查方法是用快速简便的实验检查或其他手段，是一种初步检查。对于前列腺癌的患者筛查最常用的方法是血清前列腺特异性抗原（PSA）检测（C对）。直肠指检（E错）可用于了解前列腺的形态、大小、硬度，表面是否光滑，有无结节与压痛，沟是否存在，但不能确诊前列腺癌。